患者男性，20岁，骑自行车转弯时不慎与对面行驶过来的小汽车发生碰撞，颏部着地。检查：神清，颏部皮肤裂开，渗血，耳前区肿胀、有压痛，张口度1.5cm，后牙早接触，前牙开（牙合），咬合关系紊乱。该患者可能的诊断是
A. 颏部挫裂伤
B. 颞下颌关节疾病
C. 髁突骨折
D. 颏部骨折
E. 以上都有可能

正确答案：C。髁突骨折

解析：本题考查牙槽突骨折、颌骨骨折。颏部受重力外伤，常常造成髁突的间接损伤，髁突骨折（C对）。